通草除清热利水外，又能
A. 破血通经
B. 通气下乳
C. 清肺止咳
D. 杀虫止痒
E. 祛风湿

正确答案：B。通气下乳